1945年找出某厂的1000名在表上涂镭的女工，比较这些女工与1000名女电话接线员自1945~1975年骨瘤发生率。在此期间，涂镭女工有20例骨瘤患者，而接线员只有4例。这种研究属于
A. 队列研究
B. 实验研究
C. 病例对照研究
D. 临床实验研究
E. 干预性实验研究

正确答案：A。队列研究